病例对照研究中，用于研究的一般是现患病人，由此可能产生的偏倚是
A. 伯克森偏倚
B. 奈曼偏倚
C. 易感性偏倚
D. 检出症候偏倚

正确答案：B。奈曼偏倚

解析：本题考查奈曼偏倚。病例对照研究中，用于研究的一般是现患病人，由此可能产生的偏倚是奈曼偏倚（B对ACD错），也称现患病例-新发病例偏倚。